产褥病率多发生在分娩24小时以后的几日内
A. 7日
B. 8日
C. 9日
D. 10日
E. 11日

正确答案：D。10日

解析：产褥病率指分娩24小时后的10日（D对）内，每日测量体温4次，间隔时间4小时，有2次体温≥38℃（口表）。